患者，男，72岁，体重75kg，1小时前出现右上肢体活动不利，半小时后自行缓解。查体：血压210/90mmHg；检查结果示：糖化血红蛋白9.3%，血肌酐143.2㎛ol/L。既往有高血压、糖尿病、冠心病病史。诊断为短暂性脑缺血发作。关于缺血性脑血管病抗凝治疗的说法，正确的是
A. 合并感染性心内膜炎的短暂性脑缺血发作患者应积极抗凝治疗
B. 短暂性脑缺血发作患者应常规抗凝治疗
C. 接受人工机械瓣置换术的短暂性脑缺血发作患者推荐使用新型口服抗凝药
D. 伴发心房颤动的短暂性脑缺血发作患者需要抗凝治疗
E. 合并风湿性二尖瓣病变的短暂性脑缺血发作患者，若无其它危险因素，不推荐抗凝治疗

正确答案：D。伴发心房颤动的短暂性脑缺血发作患者需要抗凝治疗

解析：本题考查缺血性脑血管病抗凝治疗。伴发心房纤颤的患者，需要抗凝治疗（D对）。抗凝治疗不作为非心源性栓塞性缺血性脑卒中或短暂性脑缺血发作的常规治疗（B错），对伴发房颤、风湿性二尖瓣病变、人工机械瓣膜的短暂性脑缺血发作患者（感染性心内膜炎除外（A错）），建议选用口服华法林抗凝治疗（C错）。因华法林起效缓慢，如需快速达到抗凝效果，可同时应用普通肝素或低分子肝素，待华法林充分发挥抗凝效果后停用肝素。对于有风湿性二尖瓣病变但无心房颤动及其它危险因素（如颈动脉狭窄）的缺血性脑卒中或短暂性脑缺血发作患者，推荐给予华法林口服抗凝治疗（E错）。